男，40岁。左下颌磨牙区颌骨逐渐膨胀1年。X线片显示下颌骨磨牙区有不规则透光区内含有大小不等的不透光团块。镜下可见肿瘤有多边形上皮细胞组成，细胞间桥清晰，上皮细胞排列成片状或岛状，细胞之间可见圆形嗜酸性均质性物质。病理诊断为
A. 成釉细胞瘤
B. 牙源性角化囊肿
C. 牙源性钙化上皮瘤
D. 成釉细胞纤维瘤
E. 牙源性腺样瘤

正确答案：C。牙源性钙化上皮瘤

解析：本题考查牙源性钙化上皮瘤。牙源性钙化上皮瘤（C对）X线显示为不规则透射区内含有大小不等的阻射性团块，镜下见肿瘤由多边形上皮细胞组成，有清晰的细胞间桥，上皮细胞排列呈片状或岛状，常见一种特征性圆形嗜酸性均质物质。成釉细胞瘤（A错）X线显示为单房或多房性透射影，边界清楚，可见硬化带。经典成釉细胞瘤组织学有多种表现如滤泡型、丛状型、棘皮瘤型、颗粒细胞型、基底细胞型、角化成釉细胞瘤。牙源性角化囊肿（B错）X线表现为单房或多房性透射区，边缘呈扇形切迹。成釉细胞纤维瘤（D错）X线表现为界限清楚的放射透光区，镜下肿瘤细胞呈条索状或团块状排列。牙源性腺样瘤（E错）X线表现为界限清楚的单房性射透射影，常围绕一个阻生牙的牙冠，镜下肿瘤上皮可形成不同结构，如结节状实性细胞巢、腺管样结构、梁状或筛状结构等。